下颌下腺导管口位于
A. 舌下肉阜
B. 舌系带
C. 舌下皱襞
D. 舌腹后份
E. 下前牙舌侧

正确答案：A。舌下肉阜

解析：本题考查下颌下腺的导管口。下颌下腺导管口位于舌下肉阜（A对）。1.下颌下腺管长约5cm，直径约2～4mm，管壁较腮腺管薄。导管起自下颌下腺浅部的深面，沿腺体的深部在下颌舌骨肌与舌骨舌肌之间前行，再经过舌下腺的内侧、颏舌肌的外侧行向前内方，途中有舌下腺管汇入，最后开口于舌系带两侧的舌下肉阜。2.腮腺管的体表投影：耳垂下缘至鼻翼下缘与口角间中点连线的中1/3段。开口于上颌第二磨牙牙冠颊面相对应的颊黏膜处。临床检查挤压腮腺时，能够见到清亮的液体从腮腺管开口处流出。3.舌下腺管有两种，即舌下腺大管和舌下腺小管。舌下腺的大部分分泌物汇入舌下腺大管，该管单独开口于舌下肉阜，或与下颌下腺管汇合再共同开口于舌下肉阜。舌下腺小管有8～20条，短而细，多数各自开口于口腔，部分小管汇入下颌下腺管。